腭前神经阻滞麻醉时上颌（牙合）平面与地平面成
A. 15°
B. 30°
C. 45°
D. 60°
E. 90°

正确答案：D。60°

解析：注射方法：患者头后仰，大张口，上颌（牙合）平面与地平面成60°角。注射针在腭大孔的表面标志稍前出刺入腭黏膜，往上后方推进至腭大孔，注入麻药0.3～0.5ml。掌握“颌面部常用局麻法及牙拔除的麻醉选择”知识点。